养阴清肺口服液善治阴虚燥咳，其处方组成的君药是
A. 玄参
B. 地黄
C. 麦冬
D. 牡丹皮
E. 白芍

正确答案：B。地黄

解析：本题考查的是养阴清肺膏的方义简释。养阴清肺口服液善治阴虚燥咳，其处方组成的君药是地黄（B对）。养阴清肺膏：【方义简释】方中地黄质润甘滋，苦寒清泄，善养阴生津、清热凉血，滋养少阴本质之不足，《本草经疏》云其：“乃补肾家之要药，益阴血之上品”，故为君药。麦冬（C错）质润甘补，微苦微寒清泄，既养肺阴，又清肺热；玄参（A错）苦泄甘润寒清，咸软入肾走血，善清热凉血、滋阴润燥、解毒散结而利咽；白芍（E错）甘补酸敛，苦微寒兼清泄，善敛阴泄热；甘草甘补和缓，平而偏凉，善补中益气，与白芍相配，能酸甘化阴，助君药以生阴液，并能清解。四药相合，既助君药养阴清肺，又凉血利咽，故共为臣药。牡丹皮（D错）苦泄辛散，微寒能清，善凉血清热、活血止痛；川贝母甘润辛散，苦微寒清泄，善清热润肺、化痰止咳、散结消肿。二药相合，既助君臣药清肺利咽，又凉血活血止痛，故为佐药。薄荷辛香疏散，凉清上浮，既清利头目与咽喉，又载药上行，故为使药。全方配伍，甘寒养润清泄，共奏养阴润燥、清肺利咽之功，故善治阴虚肺燥所致的咳嗽、咽痛，症见咽喉干痛、干咳少痰或痰中带血。